男，18岁，受凉后咳嗽，咳少量粘液、脓痰，伴发热，右侧胸痛并右肩及右上腹痛；查体：体温39.1℃，脉搏96次/分，呼吸24次/分；右侧胸廓呼吸动度减弱，语颤增强，右肺下叩诊浊音，可听到支气管呼吸音并响亮的中等湿啰音；血常规化验：白细胞15×10⁹/L，N0.90。对该患者诊断最有意义的检查是
A. 痰培养加药敏试验
B. 心电图检查
C. 腹部B超声波检查
D. 血沉肝功检查
E. 胸部X线正侧位摄片

正确答案：E。胸部X线正侧位摄片

解析：患者为青年男性（为肺炎链球菌肺炎的好发年龄），受凉后咳嗽（肺炎链球菌肺炎发病前常有受凉、淋雨史），发热、右侧胸痛合并有右肩及右上腹痛，查体右侧胸廓呼吸运动幅度减弱，语颤增强，右肺下叩诊浊音，可闻及支气管呼吸音及湿啰音，根据以上症状体征可初步怀疑为肺炎链球菌肺炎，对于进一步诊断最有意义的检查为胸部X线正侧位摄片（E对），可了解肺内病变，做出诊断。痰培养加药敏试验（A错）主要用于确诊感染病原体并进行指导用药。心电图检查（B错）对于该患者主要作用为一般监护，了解其生命体征的变化，无明显特异性变化。腹部B超声波检查（C错）可判断该患者腹痛来源，但不是最有意义的检查。血沉肝功检查（D错）也是一般检查项目，不是首选。